湿邪侵犯人体常出现面垢眵多，大便溏泻，下痢粘液脓血，小便浑浊等症状，主要是由于
A. 湿性重浊
B. 湿性趋下
C. 湿为阴邪
D. 易袭阴位
E. 湿性粘滞

正确答案：A。湿性重浊

解析：湿性重浊，“重”即沉重、附着。湿邪致病，常出现以沉重感及附着难移为特征的临床表现，如头身困重、四肢酸楚沉重并且附着难移等。如湿邪在上，则面垢、眵多；湿邪下注，则小便浑浊或滞涩不利、妇女白带过多；湿滞大肠，则大便溏泄、下痢脓血；湿邪浸淫肌肤，则可见湿疹浸淫流水等（A对）。湿性趋下（B错）易袭阴位（D错），湿邪类水属阴而有趋下之势，故湿邪为病，多易伤及人体下部。湿为阴邪（C错）易伤阳气，脾主运化水湿，性喜燥而恶湿，故外感湿邪，常易困脾，致脾阳不振，运化无权，从而使水湿内生、停聚；湿性黏滞（E错），湿邪为患，常出现分泌物和排泄物黏滞不爽的特征。